恶性胸水表现出的体征是
A. 语颤减弱
B. 叩诊呈实音
C. 肋间隙变窄
D. 呼吸运动增强
E. 呼吸音增强

正确答案：A。语颤减弱

解析：恶性胸腔积液通常由恶性肿瘤侵犯胸膜引起，由肺癌、乳腺癌和淋巴瘤等直接侵犯或转移至胸膜所致，当出现恶性胸水时患者出现患侧胸廓饱满（C错）、触觉语颤减弱（A对）、局部叩诊浊音（B错）、呼吸音减低或消失（DE错）等体征。